根据随机化的原则从总体中抽出的有代表性的观察单位组成的子集，称为
A. 总体
B. 样本
C. 变异
D. 定量资料
E. 定性资料

正确答案：B。样本

解析：样本是根据随机化的原则从总体中抽出的有代表性的观察单位组成的子集。掌握“统计基本概念和步骤”知识点。